传播的模式包括
A. 单向传播模式
B. 双向传播模式
C. 互动传播模式
D. 整体传播模式
E. 以上都是

正确答案：E。以上都是